肾小球滤过率指
A. 每侧肾脏每分钟生成的原尿量
B. 每分钟两肾生成的超滤液量
C. 每分钟两肾生成的尿的总量
D. 每分钟每侧肾脏通过的血浆量
E. 每分钟每侧肾脏的血浆滤过量

正确答案：B。每分钟两肾生成的超滤液量